在包装标识或者药品说明书中注明“运动员慎用”的是
A. 第一类疫苗
B. 第二类疫苗
C. 头孢菌素类抗生素
D. 蛋白同化制剂

正确答案：D。蛋白同化制剂

解析：本题考查含兴奋剂药品标签和说明书管理。在包装标识或者药品说明书中注明“运动员慎用”的是蛋白同化制剂（D对）。兴奋剂分为七大类，包括：刺激剂、麻醉止痛剂、蛋白同化制剂、肽类激素及类似物、利尿剂、β受体阻滞剂、血液兴奋剂等。含兴奋剂药品标签和说明书管理：《反兴奋剂条例》第十七条规定，药品中含有兴奋剂目录所列禁用物质的，生产企业应当在包装标识或者产品说明书上注明“运动员慎用”字样。药品经营企业在验收含兴奋剂药品时，应检查药品标签或说明书上是否按规定标注“运动员慎用”字样。根据《国家食品药品监督管理总局关于兴奋剂目录调整后有关药品管理的通告》（2015年第54号）的要求，兴奋剂目录发布执行后的第9个月首日起，药品生产企业所生产的含兴奋剂目录新列入物质的药品，必须在包装标识或产品说明书上标注“运动员慎用”字样。之前生产的，在有效期内可继续流通使用。疫苗分为两类。第一类疫苗（A错），是指政府免费向公民提供，公民应当依照政府的规定受种的疫苗，包括国家免疫规划确定的疫苗，省、自治区、直辖市人民政府在执行国家免疫规划时增加的疫苗，以及县级以上人民政府或者其卫生主管部门组织的应急接种或者群体性预防接种所使用的疫苗；第二类疫苗（B错），是指由公民自费并且自愿受种的其他疫苗。疫苗的包装标识：《条例》第13条规定，疫苗生产企业应当在其供应的纳入国家免疫规划疫苗的最小外包装的显著位置，标明“免费”字样以及国务院卫生主管部门规定的“免疫规划”专用标识。具体管理办法由国务院药品监督管理部门会同国务院卫生主管部门制定。